瘘孔中排出颗粒状死骨的颌骨骨髓炎是
A. 中央性颌骨骨髓炎急性期
B. 中央性颌骨骨髓炎慢性期
C. 边缘性颌骨骨髓炎增生型
D. 边缘性颌骨骨髓炎溶解破坏型
E. 新生儿颌骨骨髓炎

正确答案：E。新生儿颌骨骨髓炎

解析：本题考查新生儿颌骨骨髓炎。新生儿颌骨骨髓炎常有眶下缘或颧骨的骨质破坏，形成颗粒状死骨从瘘管排出（E对）。中央性颌骨骨髓炎下颌骨血管栓塞后可造成大块骨组织营养障碍导致死骨形成（A错）；慢性期口腔颌面部形成多数瘘孔，有时从瘘孔排出死骨片（B错）。边缘性颌骨骨髓炎增生型骨质破坏不明显，主要为增生型病变，骨密质增生，骨松质硬化，骨膜反应活跃，少量新骨形成（C错）；溶解破坏型一旦自溃或切开引流，则遗留瘘孔，常久治不愈，长期溢脓（D错）。